中医学的“急性脾心痛”相当于西医学的
A. 心绞痛
B. 肝癌
C. 胆结石
D. 急性胰腺炎
E. 急性心肌炎

正确答案：D。急性胰腺炎

解析：急性胰腺炎（D对）与中医的“胰瘅”相类似，可归属于“腹痛”、“脾心痛”等范畴。心绞痛（A错）与中医的“胸痹”相类似，可归属于“猝心痛”、“厥心痛”等范畴。肝癌（B错）属于中医学“肝积”、“癥积”、“黄疸”等范畴。胆结石（C错）可归属于中医的“癥积”范畴。急性心肌炎（E错）可归属于中医“心悸”、“胸痹”、“水肿”、“喘证”“厥证”等病范畴。